用药后有可能出现球后视神经炎的抗结核药是
A. 吡嗪酰胺
B. 利福平
C. 链霉素
D. 乙胺丁醇
E. 左氧氟沙星

正确答案：D。乙胺丁醇

解析：本题考查药物的不良反应。用药后有可能出现球后视神经炎的抗结核药是乙胺丁醇（D对）。乙胺丁醇主要不良反应为球后视神经炎，表现为弱视、红绿色盲和视野缩小。少数患者可出现皮疹、药热等过敏反应。吡嗪酰胺（A错）长期大量使用可引起肝损害，表现为氨基转移酶升高、黄疸、肝细胞坏死等。本品也可引起高尿酸血症、胃肠道反应、过敏反应等。利福平（B错）的不良反应有肝损害、消化道反应、过敏反应、流感样综合征、致畸作用等。链霉素（C错）单用易产生耐药性，长期应用发生耳毒性。临床上主要与其他抗结核病药物联合用于早期结核患者的强化治疗。左氧氟沙星（E错）属于喹诺酮类抗菌药物，不良反应有消化系统反应，肝毒性，血液系统毒性和软骨系统毒性等。